在某些传染病最短潜伏期到最长潜伏期之间，易感接触者中发病的人数占所有易感接触者总数的百分率为
A. 感染率
B. 续发率
C. 引入率
D. 超额死亡率
E. 累积死亡率

正确答案：B。续发率

解析：本题考查续发率的概念。续发率（B对ACDE错）也称二代发病率，指某些传染病在最短潜伏期到最长潜伏期之间，易感接触者中发病人数占所有易感接触者总数的百分比。